择期手术患者术前考虑支持治疗时，其血白蛋白水平一般应不低于
A. 32g/L
B. 33g/L
C. 34g/L
D. 31g/L
E. 30g/L

正确答案：E。30g/L

解析：对于严重营养不良的病人，应当予以适当的营养支持改善病人的营养状况之后再施行手术治疗（P92）。对有水、电解质及酸碱平衡失调和贫血、低蛋白血症的病人应在术前予以纠正。因此当低蛋白血症（血白蛋白水平低于30g/L）（E对）时，择期手术患者术前应考虑支持治疗。